可导致尿结晶的药品是
A. 氯苯那敏
B. 布美他尼
C. 氢氯噻嗪
D. 氨苯蝶啶
E. 磺胺嘧啶

正确答案：E。磺胺嘧啶

解析：本题考查导致尿结晶的药品。可导致尿结晶的药品是磺胺嘧啶（E对）。磺胺药主要由肾排泄，在尿液中的浓度高，可形成结晶性沉淀，易发生尿路刺激和阻塞现象，出现结晶尿、血尿、尿痛和尿闭。